RPI卡环邻面板的作用主要是
A. 防止基托下沉
B. 减少牙槽嵴受力
C. 有利美观
D. 增强义齿的固位
E. 防止食物嵌塞

正确答案：D。增强义齿的固位

解析：本题考查RPI卡环邻面板的作用。RPI卡环邻面板的作用是增强义齿的固位（D对）。RPI卡环邻面板：基牙的远中面预备导平面，使与义齿的就位道平行。制作邻面板与导平面接触。当义齿下沉时，邻面板亦随之向下，但仍与基牙接触。邻面板的作用是防止义齿脱位，且预备的导平面面积越大，义齿脱位的可能性就越小。用邻面板固位比卡环固位对支持组织的损害小。增强义齿的固位力。有防止嵌塞作用（E错），但主要还是固位。邻面板在水平方向的稳定作用很强，可使倒凹区减到最小，并可防止食物积存有利于美观，同时还与卡环臂有拮抗作用。邻面板常用于下颌牙的邻面和舌面，上颌牙因向颊侧倾斜，不宜作导平面及邻面板。防止基托下沉的是近中（牙合）支托（A错）。因为颊侧I杆的设计不与基托直接相连，所以义齿所受（牙合）力会直接作用在基托上，并传导到基托下的压槽嵴，使压槽嵴所受（牙合）力增加（B错）。有利美观的是I杆，与基牙接触面积小，且患龋率低（C错）。